主要通过肝药酶抑制作用引起药物相互作用的联合用药是
A. 氯霉素+甲苯磺丁脲
B. 阿司匹林+格列本脲
C. 保泰松+洋地黄毒苷
D. 苯巴比妥+布洛芬
E. 丙磺舒+青霉素

正确答案：A。氯霉素+甲苯磺丁脲

解析：本题考查肝药酶抑制作用。主要通过肝药酶抑制作用引起药物相互作用的联合用药是氯霉素+甲苯磺丁脲（A对）；阿司匹林的代谢产物水杨酸盐将与血浆蛋白结合的格列本脲（B错）置换出来，使游离的格列本脲浓度升高，从而引起低血糖；保泰松（C错）、苯巴比妥（D错）属于肝药酶诱导剂；丙磺舒与青霉素（E错）合用可增强青霉素的疗效，原因是竞争性抑制青霉素自肾小管的分泌。